由于HIV引起的口腔毛状白斑通常发生于口腔哪个部位
A. 舌的外侧缘
B. 颊黏膜
C. 软腭黏膜
D. 口底黏膜
E. 鼻腔黏膜

正确答案：A。舌的外侧缘

解析：本题考查艾滋病的口腔表现。由于HIV引起的口腔毛状白斑通常发生于舌的外侧缘（A对）。毛状白斑主要表现为双侧舌缘呈白色或灰白斑块，有的可蔓延至舌背和舌腹，在舌缘呈垂直皱褶外观，如过度增生则成毛茸状，不能被擦去。一般不会发生于颊黏膜（B错）、软腭黏膜（C错）、口底黏膜（D错）和鼻腔黏膜（E错）。